新大环内酯抗生素的药理学特征有
A. 抗菌谱扩大
B. 组织、细胞内药物浓度高
C. 抗菌活性增强
D. 对酸稳定，口服吸收好
E. 对红霉素耐药菌有效

正确答案：A、B、C、D、E。抗菌谱扩大；组织、细胞内药物浓度高；抗菌活性增强；对酸稳定，口服吸收好；对红霉素耐药菌有效

解析：本题考查大环内酯类药物的药理学特征。大环内酯类抗菌药第一代口服吸收少，第二代经结构改造后，增加了对酸的稳定性，口服吸收好（D对），生物利用度高，半衰期延长，细胞内浓度高（B对）。抗菌谱扩大（A对），抗菌活性增强（C对）。第三代大环内酯类抗生素对一、二代大环内酯耐药菌作用增强（E对）。